药师在指导患者合理用药时，应同时关注药物、食物、和膳食补充剂的相互影响。下列合用方式合理的是
A. 左甲状腺素与钙剂同服
B. 硫酸亚铁与维生素C同服
C. 华法林与人参同服
D. 异烟肼与牛奶同服
E. 利福平与脂肪餐同服

正确答案：B。硫酸亚铁与维生素C同服

解析：本题考查铁剂的使用。硫酸亚铁与维生素C同服（B对），可促进铁剂的吸收，属于合理性用药。左甲状腺素与钙剂合用（A错）可能引起高钙血症，严禁合用。人参会减弱华法林（C错）的抗凝作用，不宜同服。牛奶中含有金属离子，异烟肼易与金属离子络合而失去活性，使异烟肼吸收减少、疗效降低（D错）。利福平与脂肪食物同服（E错）会减弱或抵抗利福平的疗效。